抗力形的定义是
A. 使充填物能够承受咀嚼力量
B. 使充填物和牙齿能承受咀嚼力量
C. 使牙齿能够承受咀嚼力量
D. 使充填物不松动脱落

正确答案：B。使充填物和牙齿能承受咀嚼力量

解析：本题考查在抗力形的定义。抗力形是使充填物和牙齿能承受咀嚼力量（B对AC错），在承受咬合力时不折裂的形状。固位形是使充填体在侧向或垂直方向力量作用下不移位、脱落的形状（D错）。